儿童心理发育的物质基础是
A. 运动系统发育
B. 消化系统发育
C. 神经系统发育
D. 生殖系统发育
E. 语言发育

正确答案：C。神经系统发育

解析：本题考查神经心理发育的相关内容。神经系统（C对ABDE错）的发育是儿童心理发育的物质基础，神经系统发育正常与否与儿童心理发育密切相关。